可能导致牙龈出血的药物是
A. 拉西地平
B. 依诺肝素
C. 普伐他汀
D. 普萘洛尔
E. 呋塞米

正确答案：B。依诺肝素

解析：本题考查药物的不良反应。依诺肝素（B对）可能导致牙龈出血。拉西地平（A错）可能引起下肢及踝部水肿、牙龈增生。普伐他汀（C错）可能引起肌痛、肌病、横纹肌溶解症、肝脏氨基转移酶AST及ALT升高。普萘洛尔（D错）的不良反应有乏力、嗜睡、头晕、失眠、恶心、腹泻、皮疹、晕厥、低血压、心动过缓等。呋塞米（E错）的不良反应为水、电解质紊乱。